下列选项中仅属于医师的道德义务不属于法律义务的是
A. 努力钻研业务，提高专业技术水平
B. 关心、爱护、尊重患者、保护患者隐私
C. 宣传卫生保健知识，对患者进行健康教育
D. 遵守法律、法规、遵守技术操作规范
E. 积极开展义诊，尽力满足患者的健康需求

正确答案：E。积极开展义诊，尽力满足患者的健康需求

解析：努力钻研业务，提高专业技术水平（A对）；关心、爱护、尊重患者、保护患者隐私（B对）；宣传卫生保健知识，对患者进行健康教育（C对）；遵守法律、法规、遵守技术操作规范（D对）既属于医师的道德义务，也属于医师的法律义务，而积极开展义诊，尽力满足患者的健康需求（E错，为本题正确答案）只是道德义务，不属于法律义务，不是医师在法律上必须要做的。